决定流感病毒型别的主要型特异性抗原是
A. HA和NA
B. NP和M1
C. NP和HA
D. M1和NA
E. NP和NA

正确答案：B。NP和M1

解析：本题考查决定流感病毒型别的主要型特异性抗原。NP和M1（B对ACDE错）是决定流感病毒型别的主要型特异性抗原。根据流感病毒NP和M1抗原特异性及其基因特性的不同，分为甲（A）、乙（B）、丙（C）三型。